正常成人自然开口度平均约为
A. 4.0cm
B. 3.0cm
C. 3.5cm
D. 3.7cm
E. 4.7cm

正确答案：D。3.7cm

解析：本题考查开口度。正常成人自然开口度平均约为3.7cm（D对）。开口度是指受检查者大开口时，上、下颌中切牙近中切角之间的垂直距离。正常开口度平均为3.7cm，小于3.7cm为受限，大于5.0cm为开口过大。